通过感觉、知觉、记忆等进行的活动称为
A. 意志过程
B. 人格倾向
C. 情感过程
D. 人格特征
E. 认知过程

正确答案：E。认知过程

解析：认知过程是指人们获得知识或应用知识的过程，或信息加工的过程，这是的最基本的心理过程，它包括感觉、知觉、记忆、想象、思维和语言等（E对）。人不仅能认识事物，体验对事物的态度，而且还能为了满足某种需要，自觉地确定目的，制订计划，克服困难，努力达到目的，这就是人的意志过程（A错）。人格倾向性是决定人对客观事物的态度和行为的基本动力，主要是在后天社会化过程中形成。人格倾向性主要包含需要、动机、兴趣、理想、信念和世界观等（B错）。产生态度或体验的过程就是情绪情感过程（C错）。人由于先天素质不一样，生活的环境和受到的教育也存在差别，以及从事的实践活动的不同，人在活动的过程中，会表现出其各自的独特的特点，这些特点就是他的人格特特征（D错）。